判断呼吸性酸中毒的重要指标
A. PaCO₂
B. PaO₂
C. HCO₃⁻浓度
D. PH
E. H⁺浓度

正确答案：A。PaCO₂

解析：PaCO₂和pH都是判断呼吸性酸中毒的重要指标，但在慢性呼吸性酸中毒时，血pH下降不明显，故选择PaCO₂（A对）。